根据充分病因-组分病因模型，若某疾病的所有病例均具有病因X，则对X的最佳描述是
A. 充分病因
B. 组分病因
C. 必要病因
D. 互补病因
E. 必要且充分病因

正确答案：C。必要病因

解析：本题考查充分病因-组分病因模型的相关内容。若某疾病的所有病例均具有病因X，则X是必要病因（C对ABDE错），即这个病因是疾病发生所必需的组分病因。